根据《处方药与非处方药分类管理办法（试行）》，对药品分别按处方药与非处方药进行分类管理是根据
A. 药品品种、规格、适应症、剂型及给药途径的不同
B. 药品类别、规格、适应症、剂量及给药途径的不同
C. 药品品种、规格、适应症、剂量及给药途径的不同
D. 药品品种、包装、适应症、剂型及给药途径的不同
E. 药品数量、规格、适应症、剂量及给药途径的不同

正确答案：C。药品品种、规格、适应症、剂量及给药途径的不同

解析：本题考查药品分类。根据《处方药与非处方药分类管理办法（试行）》，对药品分别按处方药与非处方药进行分类管理是根据药品品种、规格、适应症、剂量及给药途径的不同（C对）。《处方药与非处方药分类管理办法（试行）》第二条：根据药品品种、规格、适应症、剂量及给药途径不同，对药品分别按处方药与非处方药进行管理。处方药必须凭执业医师或执业助理医师处方才可调配、购买和使用；非处方药不需要凭执业医师或执业助理医师处方即可自行判断、购买和使用。